DNA分子上能被RNA聚合酶特异结合的部位称为
A. 外显子
B. 增强子
C. 密码子
D. 终止子
E. 启动子

正确答案：E。启动子